小儿鹅口疮心脾积热证，应首选
A. 清胃散
B. 清热泻脾散
C. 六味地黄丸
D. 泻心导赤汤
E. 凉膈散

正确答案：B。清热泻脾散

解析：清胃散功能清胃凉血，主治胃火牙痛证（A错）。鹅口疮心脾积热证治宜清心泻脾，泻火清疮，方选清热泻脾散（B对）。六味地黄丸功能滋补肝肾，为口疮虚火上浮证的选方（C错）。泻心导赤散功能清心凉血，泻火解毒，为治疗口疮心火上炎证的选方（D错）。凉膈散可用于治疗口疮风热乘脾证以散风清热，祛火清疮（E错）。